（104～105题共用题干）女，26岁。人流后5个月，阴道不规则出血20天，伴头晕、乏力3天。近2天，出现胸痛、咯血。妇科检查：子宫孕7周大小，质软，有轻度压痛，双侧可触及囊性肿物，直径均为5cm大小。胸部X线片提示双下肺多发圆形结节影。确诊后首选的治疗方法是
A. 内分泌治疗
B. 化疗
C. 子宫切除术+双侧附件切除术
D. 子宫切除术
E. 放疗

正确答案：B。化疗

解析：患者女，26岁。人流后5个月，阴道不规则出血20天，伴头晕、乏力3天（阴道流血，人流后继发妊娠滋养细胞肿瘤典型表现，无葡萄胎病史）。近2天，出现胸痛、咯血（绒癌肺转移）。妇科检查：子宫孕7周大小（子宫增大），质软，有轻度压痛，双侧可触及囊性肿物，直径均为5cm大小。胸部X线片提示双下肺多发圆形结节影（X线征象发展为片状或小结节阴影是妊娠滋养细胞肿瘤常见表现）（P340），本患者可诊断为绒癌，绒癌首选以化疗为主的综合性治疗（B对）。内分泌治疗（A错）较少用于治疗绒癌。放疗（E错）应用较少，可辅助治疗。子宫切除、双附件切除应用于无生育要求的患者（CD错）。